医学伦理学的研究对象是
A. 医学道德难题
B. 医德基本理论
C. 医学道德关系
D. 医德基本实践
E. 医德基本规范

正确答案：C。医学道德关系

解析：医学伦理学的研究对象是医学道德关系（C对），包括医学实践中所有的医德现象，即以医患关系道德为核心的医疗、预防、科研、健康诸方面的医德活动、医德关系、医德意识等等。医学道德难题（A错）、医德基本理论（B错）、医德基本规范（E错）仅涉及医德的一方面。医德基本实践（D错）为医德修养的要求。